十二经脉的功能反应于体表的是
A. 十二皮部
B. 十二经筋
C. 十二经别
D. 十五别络
E. 奇经八脉

正确答案：A。十二皮部

解析：由于十二皮部分属于十二经脉，而十二经脉又内属于脏腑，所以脏腑、经络的病变亦能在相应的皮部分区反映出来，故在临床上观察不同部位皮肤的色泽和形态变化，即可诊断某些脏腑、经络的病变（A对）。